流行病学研究对象的三个层次是指
A. 疾病、伤害、健康
B. 病人、非病人、一般人群
C. 传染病、慢性病、慢性非传染性疾病
D. 死亡、患病、健康
E. 疾病、健康、突发事件

正确答案：A。疾病、伤害、健康